药学职业道德准则的重要内容之一是
A. 敬业爱岗、尽职尽责
B. 尊重科学、精益求精
C. 不为名利、廉洁奉公
D. 语言亲切、态度和蔼
E. 尊重人格、保护患者

正确答案：B。尊重科学、精益求精